下列检查结果中，最能反映慢性肾炎患者肾实质严重损害的是
A. 尿蛋白明显增多
B. 尿中白细胞明显增多
C. 尿中红细胞明显增多
D. 尿中出现管型
E. 尿比重固定于1.010左右

正确答案：E。尿比重固定于1.010左右

解析：尿蛋白明显增多（A错）、尿中白细胞明显增多（B错）、尿中红细胞明显增多（C错）、尿中出现管型（D错）都可提示肾实质病变，但慢性肾炎患者尿比重固定在1.010左右的等张尿时，表明肾小管重吸收功能很差，肾小管病变严重，故尿比重固定于1.010时最能反映慢性肾炎患者肾实质严重损害（E对）。